脉络丛前动脉发自
A. 颈内动脉
B. 大脑前动脉
C. 大脑后动脉
D. 小脑上动脉
E. 基底动脉

正确答案：A。颈内动脉

解析：大脑血液供应来源于颈内动脉和椎动脉，左、右椎动脉入颅后合并成一条基底动脉。脉络丛前动脉发自颈内动脉（A对）；大脑前动脉（B错）也发自颈内动脉。大脑后动脉（C错）、小脑上动脉（D错）均发自基底动脉（E错）。